为适应治疗或预防的需要而制备的药物应用形式称为
A. 药物剂型
B. 药物制剂
C. 药剂学
D. 调剂学
E. 方剂

正确答案：A。药物剂型

解析：本题考查药物的剂型与制剂。为适应治疗或预防的需要而制备的药物应用形式称为药物剂型（A对）。药物在临床应用之前，为了充分发挥药效、减少毒副作用、便于运输、使用与保存，将药物制成适合于医疗或预防应用的形式。这种适合于疾病的诊断、治疗或预防的需要而制备的不同给药形式，称为药物剂型。药物制剂（B错）是指将原料药物按照某种剂型制成一定规格并具有一定质量标准的具体品种，简称制剂。药剂学（C错）是研究药物配制理论、生产技术以及质量控制合理利用等内容的综合性应用技术学科。调剂学（D错）是研究方剂的调制技术、理论和应用的科学。方剂（E错）是按医师处方专为某一患者调制的，并明确规定用法用量的药剂。